输卵管全程由内侧向外侧分为四部，即
A. 子宫部，壶腹部、峡部、漏斗部
B. 漏斗部、峡部、壶腹部、子宫部
C. 子宫部、峡部、壶腹部、输卵管伞
D. 子宫部、峡部、壶腹部、漏斗部
E. 峡部、壶腹部、漏斗部、输卵管伞

正确答案：D。子宫部、峡部、壶腹部、漏斗部

解析：子宫部、峡部、壶腹部、漏斗部（D对）是输卵管全程由内侧向外侧分的四部。